女，23岁。半年前祖父去世送葬，极为悲伤，回家后，自称是一位己死2年的青年男性附其身上，并以男青年的身份和口气与人说话，持续4小时，之后反复发作十几次，均有精神诱因，神经系统检查未见阳性体征，最可能的诊断是
A. 恐惧症
B. 精神分裂症
C. 分离性障碍
D. 强迫症
E. 焦虑症

正确答案：C。分离性障碍

解析：该患者因半年前祖父去世（应激事件），极为悲伤，称青年男性附其身上（出神状态），并以男青年的身份和口气与人说话（附体状态）（时间上与应激事件有明确联系），神经系统检查未见阳性体征（排除神经系统疾病），故诊断为分离性障碍（C对）。恐惧症是一种以过分和不合理地惧怕外界某种客观事物（黑暗、雷电）或情境（公众场合发表演讲）为主要表现，患者明知这种恐惧反应是过分的或不合理的，但仍反复出现，本例无此症状，故不考虑（A错）。分离性（转换）性障碍患者出现出神和附体状态易与精神分裂症所出现的症状相混淆，但精神分裂症患者所表现症状多与外界环境无相应联系，而分离（转换）性障碍患者表情生动，情感外露，与本例不符（B错）。焦虑症以焦虑为主要临床表现，患者常常有不明原因的提心吊胆、紧张不安，无分离（转换）性障碍症状（出神和附体），故不考虑（E错）。